急性白血病患者，出现头痛呕吐，颈强直，脑脊液压力增高，蛋白增多，糖减少，细胞大多为白血病细胞。鞘内注射首选药物是
A. 环磷酰胺
B. 三尖杉酯碱
C. 长春新碱
D. 甲氨蝶呤
E. 6﹣巯基嘌呤

正确答案：D。甲氨蝶呤

解析：急性白血病患者如果出现出现头痛呕吐，颈强直，脑脊液压力增高等症状时，则是发生了中枢神经系统白血病。由于化疗药物难以通过血脑屏障，隐藏在中枢神经系统的白血病细胞不能有效被杀死，因而引起中枢神经系统白血病。甲氨蝶呤（MTX）可以透过血脑屏障，竞争性结合二氢叶酸还原酶，减少还原型叶酸生成，影响细胞分裂增殖，直接杀灭白血病细胞，是急性淋巴细胞白血病的治疗药物（D对）；环磷酰胺、三尖杉酯碱、长春新碱、6-巯基嘌呤均无法靶内注射（ABCE错）。